男，55岁。颈后肿痛5天。疼痛逐渐加重，伴畏寒、发热。既往糖尿病病史10年。查体：T38.5℃，P90次/分，R18次/分，BP120/80mmHg，颈后红肿，范围约5cm，边界不清，中央多个脓点。双肺呼吸音清，未闻及干湿性啰音，心律齐。该患者最可能的诊断是
A. 皮脂腺囊肿感染
B. 痈
C. 疖
D. 急性蜂窝织炎
E. 丹毒

正确答案：B。痈

解析：患者老年男性，既往有糖尿病，畏寒、发热，颈后疼痛，红肿，边界不清，中央多个脓点，可诊断为痈（B对）。皮脂囊肿为皮脂腺排泄受阻所致潴留性囊肿，多见于皮脂腺分布密集的部位如头面和背部，表面可见皮脂腺开口的小黑点，并发感染时有奇臭（A错）。疖表现为单个毛囊的急性化脓性感染，全身症状较轻（C错）。急性蜂窝织炎主要表现为红肿热痛，炎症不易局限，肿胀明显，边界不清（D错）。丹毒指皮肤淋巴管炎，多见于下肢，表现为片状皮肤红疹、微隆起、色鲜红、中间稍淡、境界较清楚（E错）。